附子与肉桂均可治疗的病证是
A. 亡阳暴脱，四肢厥逆
B. 元气暴脱，虚汗脉微
C. 肾阳不足，畏寒肢冷
D. 气虚不足，倦怠乏力
E. 神志昏迷，不省人事

正确答案：C。肾阳不足，畏寒肢冷

解析：附子的功效为回阳救逆，补火助阳，散寒止痛。可用于治疗亡阳虚脱，肢冷脉微；肾阳虚衰、阳痿宫冷，虚寒吐泻、脘腹冷痛，阴寒水肿，心阳不足、胸痹冷痛，阳虚外感；寒湿痹痛。肉桂的功效为补火助阳，散寒止痛，温通经脉，引火归元。可用于治疗肾阳不足，命门火衰，阳痿宫冷，腰膝冷痛；心腹冷痛，虚寒吐泻，寒疝腹痛；冲任虚寒、寒凝血滞之痛经经闭，寒湿痹痛，阴疽流注；肾虚作喘，虚阳上浮，眩晕目赤。两药均可用于治疗肾阳不足，微寒肢冷（C对）。